一患者被人用刀划伤面部软组织，耳前区皮肤有长约6cm的纵行创口，创缘整齐，有活动出血。如有知名血管断裂，最宜采用的止血方法是
A. 指压止血
B. 填塞止血
C. 药物止血
D. 包扎止血
E. 结扎止血

正确答案：E。结扎止血

解析：本题考查止血的方法。患者被人用刀划伤面部软组织，耳前区皮肤有长约6cm的纵行创口，创缘整齐，有活动出血（符合切割伤的临床表现）。如有知名血管断裂，最宜采用的止血方法是结扎止血（E对），结扎止血多用于大血管出血。指压止血法（A错）是用手指压迫出血部位知名供应动脉的近心端，适用于出血较多的紧急情况，作为暂时性止血，然后再改用其他确定性方法作进一步止血。填塞止血法（B错）可用于开放性和洞穿性创口，也可用于窦腔出血。药物止血（C错）适用于创面渗血、小静脉和小动脉出血。包扎止血法（D错）可用于毛细血管、小静脉及小动脉的出血，或创面渗血。